患者，女，36岁，已婚，面色萎黄，神疲乏力，气短懒言，食少便溏，月经淋漓不断，经血色淡，舌淡无苔，脉沉细无力。其病机是
A. 脾不统血
B. 脾肾阳虚
C. 气血两虚
D. 脾肺气虚
E. 肝血不足

正确答案：A。脾不统血

解析：脾不统血，是指脾气亏虚不能统摄血液所表现的证候。面色萎黄，神疲乏力，气短懒言，均多因化源亏少，气血不足，头面失于滋养，机能衰减所致；食少便溏多因脾气虚弱，运化失职所致；月经淋漓不断多因脾气亏虚，统血无权，血溢脉外，冲任不固所致；经血色淡，舌淡无苔，脉沉细无力，均多因脾气虚弱，气血两虚所致。故为脾不统血（A对）。脾肾阳虚的辨证要点以久泻久痢、水肿、腰腹冷痛与虚寒症状共见等为主要表现，非上述症状（B错）。气血两虚的辨证要点以面色淡白或萎黄、心悸气短、眩晕乏力等为主要表现。非上述症状（C错）。脾肺气虚的辨证要点以食少腹胀便溏、咳喘气短与气虚症状共见等为主要表现，非上述症状（D错）。肝血不足的辨证要点以筋脉、爪甲、目睛失养与血虚症状共见等为主要表现，非上述症状（E错）。